38岁女性，洗衣时突发右侧肢体活动不灵，查体：意识清，失语，二尖瓣区可闻双期杂音，心律不齐，右侧偏瘫，上肢重于下肢，偏身痛觉减退，首先考虑的诊断
A. 脑血栓形成
B. 脑栓塞
C. 脑出血
D. 蛛网膜下腔出血
E. 短暂脑缺血发作

正确答案：B。脑栓塞

解析：中年女性患者，突发右侧肢体活动不灵，查体：意识清，失语，二尖瓣区可闻双期杂音（提示二尖瓣瓣膜异常），心律不齐，右侧偏瘫，上肢重于下肢，偏身痛觉减退，根据患者的临床症状及体征，首先考虑的诊断是心源性脑栓塞（B对），该病多急性起病，常表现为上肢瘫痪重，下肢瘫痪轻。脑血栓（A错）形成是逐渐发病的，且临床症状没有脑栓塞严重。脑出血（C错）好发于50岁以上的患者，好发于情绪激动后，常有头痛、呕吐和不同程度的意识障碍。蛛网膜下腔出血（D错）主要表现突发剧烈的头痛。短暂脑缺血发作（E错）好发于中老年人，发病突然，局部脑或视网膜功能障碍历时短暂，最长时间不超过24小时，不留后遗症状。